营养物质吸收最主要的部位是
A. 食管
B. 口腔
C. 胃
D. 小肠
E. 大肠

正确答案：D。小肠